有关梅毒所致下疳描述有误的是
A. 发生于一期梅毒
B. 梅毒螺旋体进入体内2～4个月后开始发病
C. 男性常见于冠状沟
D. 男性常见于龟头、阴茎
E. 女性多见于大小阴唇部位

正确答案：B。梅毒螺旋体进入体内2～4个月后开始发病

解析：一期梅毒：梅毒螺旋体进入皮肤或黏膜后。即开始繁殖，并使局部发生炎症，2～4周后在螺旋体进入部位发生溃疡和糜烂，称为下疳。下疳在男性最常见于冠状沟、龟头、阴茎等处，在女性多见于大小阴唇部位。掌握“梅毒的口腔表征”知识点。